肿瘤的发生可能与下列哪项因素有关
A. 煤焦油、吸烟
B. 维生素B和维生素E类缺乏
C. 严重的精神创伤
D. 内分泌功能紊乱
E. 以上均有关

正确答案：E。以上均有关

解析：肿瘤病因至今尚未明了，一般认为是外来和内在的多种致病因素综合作用的结果。各个选项的说法都是正确的，均有关。掌握“口腔颌面部肿瘤的概念、临床表现、诊断”知识点。